伤寒病病原学检查时，病程1周应采集的标本是
A. 痰液或唾液
B. 尿液
C. 血或骨髓
D. 粪便
E. 肠引流液

正确答案：C。血或骨髓